风湿性心脏病主动脉瓣狭窄常见的临床“三联征”是
A. 呼吸困难、心绞痛、房颤
B. 呼吸困难、心绞痛、晕厥
C. 呼吸困难、心绞痛、细迟脉
D. 心绞痛、晕厥、细迟脉
E. 心绞痛、细迟脉、晕厥

正确答案：B。呼吸困难、心绞痛、晕厥

解析：风湿性心脏病主动脉瓣狭窄常见的临床“三联征”是心绞痛、晕厥和心力衰竭，这是八版内科学最新的观点。七版内科学指出主动脉瓣狭窄常见的临床“三联征”是呼吸困难、心绞痛、晕厥，因此本题原给出答案为B。考生记忆应以八版内科学观点为准。